八脉交会穴中通带脉的是
A. 足三里
B. 阳陵泉
C. 悬钟
D. 足临泣
E. 公孙

正确答案：D。足临泣

解析：足三里为足阳明胃经合穴，胃下合穴（A错）。阳陵泉为足少阳胆经合穴，胆下合穴，八会穴之筋会（B错）。悬钟为八会穴之髓会（C错）。足临泣为足少阳胆经输穴，八脉交会穴（通于带脉）（D对）。公孙为足太阴脾经的络穴，八脉交会穴（通于冲脉）（E错）。记忆：八脉交会八穴歌